对药品生产企业的新药品种设立的监测期为
A. 6年
B. 5年
C. 8年
D. 7年
E. 10年

正确答案：B。5年

解析：本题考查新药监测期。对药品生产企业的新药品种设立的监测期为5年（B对）。根据《中华人民共和国药品管理法实施条例》第三十三条规定，国务院药品监督管理部门根据保护公众健康的要求，可以对药品生产企业生产的新药品种设立不超过5年的监测期；在监测期内，不得批准其他企业生产和进口。